治疗甲状腺功能亢进症的药品有
A. 丙硫氧嘧啶
B. 左甲状腺素片
C. 甲巯咪唑
D. 甲状腺片
E. 卡比马唑

正确答案：A、C、E。丙硫氧嘧啶；甲巯咪唑；卡比马唑

解析：本题考查甲亢的治疗药。常用的治疗甲亢的药物：1.硫脲类，如甲硫氧嘧啶、丙硫氧嘧啶（A对）、甲巯咪唑（C对）、卡比马唑（E对）等。2.碘及碘化物，如复方碘溶液、碘化钾、碘化钠等。3.放射性碘。4.β受体拮抗剂，如普萘洛尔、美托洛尔、阿替洛尔等。左甲状腺素片（B错）和甲状腺片（D错）用于治疗甲状腺功能减退症。